患者的角色特征中不包括的是
A. 免除原有的社会职责
B. 不必对陷入疾病状态负责
C. 寻求帮助
D. 有一定的社会规范性
E. 恢复健康的义务

正确答案：D。有一定的社会规范性

解析：1951年，美国社会学家帕森斯提出了患者的四种角色特征：1)免除或部分免除社会职责；2)不必对陷入疾病状态负责；3)寻求帮助；4)恢复健康的义务。掌握“患者角色和求医行为”知识点。